判定新生儿轻度窒息是指生后1分钟的Apgar评分为
A. 0～1分
B. 2～3分
C. 4～7分
D. 5～8分
E. 8～10分

正确答案：C。4～7分

解析：Apgar评分是国际上公认的评价新生儿窒息最简洁最实用的方法，内容包括皮肤颜色、心率、对刺激的反应、肌张力和呼吸五项指标，每项0～2分，总共10分。Apgar评分的结果：8-10分无窒息，4-7分轻度窒息（C对），0-3分重度窒息。